关于妊娠期母体内分泌系统的变化正确的是
A. 腺垂体不增大
B. 垂体催乳激素增多
C. 甲状腺功能低下
D. 皮质醇分泌减少
E. 醛固酮分泌减少

正确答案：B。垂体催乳激素增多

解析：妊娠期母体内分泌系统的变化包括：垂体、肾上腺皮质和甲状腺。妊娠期初期稍增大，尤其在妊娠末期，腺垂体增生肥大明显（A错）：①促性腺激素，妊娠黄体及胎盘分泌大量雌激素及孕激素，对下丘脑及腺垂体的负反馈作用，使促性腺激素分泌减少，故妊娠期间卵巢内的卵泡不再发育成熟，也无排卵；②催乳激素，妊娠7周开始增多，随妊娠进展逐渐增量，妊娠足月分娩前达高峰约150μg/L，为非孕妇女10μg/L的10倍。催乳激素促进乳腺发育，为产后泌乳作准备（B对）。肾上腺皮质：①皮质醇，为主要的理糖激素，因妊娠期雌激素大量增加，使中层束状带分泌的皮质醇增多3倍（D错）；②醛固酮，为主要的理盐激素，因妊娠期雌激素大量增加，外层球状带分泌的醛固酮于妊娠期增加4倍（E错）；③睾酮，使内层网状带分泌的睾酮略有增加，表现为孕妇阴毛及腋毛增多增粗。甲状腺：妊娠期由于腺组织增生和血运丰富，甲状腺呈均匀增大，约比非孕时增大65%。受大量雌激素影响，肝脏产生的甲状腺素结合球蛋白增加2-3倍。血循环中的甲状腺激素虽增多，但游离甲状腺激素并未增多，故孕妇通常无甲状腺功能亢进表现（C错）。